随着经济发展，人们的生活节奏加快，竞争加剧，什么成为日益严重的社会问题
A. 环境污染
B. 生活方式
C. 现代文明病
D. 心理健康
E. 人口流动

正确答案：D。心理健康